转复长QT间期所致尖端扭转型室速的最适宜药物是
A. 肾上腺素
B. 利多卡因
C. 普罗帕酮
D. 硫酸镁
E. 胺碘酮

正确答案：D。硫酸镁

解析：转复长QT间期所致的尖端扭转型室性心动过速最佳药物是镁盐，即硫酸镁（D对）。对心动过缓和明显长间歇依赖者可考虑心房或心室临时起搏，在等待临时起搏时，可以短时间使用肾上腺素提高心率，但并不用于尖端扭转型室性心动过速的治疗（A错）。利多卡因（九版药理学P196）主要治疗室性心律失常，如心脏手术、心导管术、急性心肌梗死或强心苷中毒所致的室性心动过速或心室纤颤。但对转复长QT间期所致的尖端扭转型室性心动过速常无效果（B错）。普罗帕酮（C错）和胺碘酮（E错）均可使QT间期更加延长（P205）。